以下最不宜行组织活检术的恶性肿瘤为
A. 舌癌
B. 唇癌
C. 恶性淋巴瘤
D. 恶性黑色素瘤
E. 肉瘤

正确答案：D。恶性黑色素瘤

解析：本题考查活组织检查。组织活检是指从病变部位取一小块组织制成切片，通过适当染色后，在显微镜下观察细胞的形态和结构，以确定病变性质.肿瘤类型及分化程度。恶性黑色素瘤（D对）不宜行组织活检，即使是转移性淋巴结也不可做吸取组织检查，因为活检可促使其增长，是肿瘤播散发生远处转移。恶性淋巴瘤（C错）临床表现呈多型性，主要靠组织活检术确诊。舌癌（A错）、唇癌（B错）、肉瘤（E错）均可通过组织活检术确诊且不会造成转移。